牙周病的局部促进因素不包括
A. 牙石及白垢
B. 食物嵌塞
C. 咬合创伤
D. 酸、碱等化学刺激
E. 不良充填物及修复体

正确答案：D。酸、碱等化学刺激

解析：本题考查牙周病的局部促进因素。酸、碱等化学刺激（D错，为本题的正确答案）对牙菌斑的堆积无促进作用。牙周病的局部促进因素有：牙石（A对）；解剖因素；牙齿位置异常、拥挤和错（牙合）畸形；其他促进因素如充填体悬突、修复体的设计、修复体材料、正畸治疗等（E对）；（牙合）创伤（C对）；食物嵌塞（B对）；不良习惯；牙面着色等，这些因素会促进或有利于牙菌斑（牙周病的始动因子）的堆积，或对已存在的牙周病起加重或加速破坏的作用。